面瘫的贝尔征是指
A. 用力紧闭眼睑，则眼球转向外上方
B. 患侧口角下垂，健侧向上歪斜
C. 不能鼓腮、吹气
D. 睑裂过大,闭合不全
E. 结膜囊内常有泪液积滞

正确答案：A。用力紧闭眼睑，则眼球转向外上方

解析：本题考查面瘫的贝尔征。面瘫的贝尔征是指用力紧闭眼睑，则眼球转向外上方（A对）。面瘫的典型症状有：患侧口角下垂，健侧向上歪斜（B错）。上下唇因口轮匝肌瘫痪而不能紧密闭合，故发生饮水漏水、不能鼓腮、吹气（C错）等功能障碍。由于眼轮匝肌瘫痪，失去了受动眼神经支配的上睑提肌保持平衡协调的随意动作，致睑裂扩大、闭合不全（D错）、露出结膜。用力闭眼时，则眼球转向外上方，此称贝尔征，由于不能闭眼，故易患结膜炎。在下结膜囊内常有泪液积滞（E错），这种泪液运行障碍，一般是由于泪囊肌瘫痪与结膜炎等原因所引起。